在石膏模型上制作后堤区时，最宽处的宽度为
A. 1mm
B. 3mm
C. 5mm
D. 8mm
E. 10mm

正确答案：C。5mm

解析：本题考查模型后堤区的处理。后堤区是指上腭前后颤动线之间，可稍加压力，作为上颌义齿后缘封闭区的区域。一般在腭小凹和两侧翼上颌切迹连线后约2mm处为后堤区的后缘，后堤区通常为弓形，最宽处的宽度在腭小凹的两侧与翼上颌切迹之间约为4～5mm（C对）,最窄处宽度为2mm，两侧向后缘移行，逐渐变浅。